南沙参的原植物属于
A. 萝摩科
B. 葫芦科
C. 天南星科
D. 莎草科
E. 桔梗科

正确答案：E。桔梗科